具有麻醉药品处方资格的执业医师违反规定开具麻醉药品造成严重后果的，卫生行政部门依法对其作出的处理是
A. 警告
B. 吊销执业证书
C. 暂停执业半年
D. 取消麻醉药品处方资格
E. 罚款

正确答案：B。吊销执业证书

解析：《执业医师法》规定，执业医师在执业活动中，不按照规定使用麻醉药品、医疗用毒性药品、精神药品和放射性药品的，由县级以上人民政府卫生行政部门给予警告（A错）或者责令暂停6个月以上1年以下执业活动（C错）；情节严重，造成严重后果的，吊销执业证书（B对）；构成犯罪的，依法追究刑事责任。